某地2500例心绞痛患者的生存率中，其中位生存时间为
A. 2.7年
B. 3.5年
C. 4.3年
D. 5.3年
E. 6.5年

正确答案：D。5.3年

解析：本题考查中位生存时间的相关内容。利用寿命表法估计大样本分组资料生存率，其中位生存时间的计算与K-M法一致，只是如果样本生存率中有S∧（tᵢ）=0.5，则半数生存期T₅₀等于其区间的上限时间；如果样本生存率中没有0.5，仍采用插值法进行估计。由表可见，中位生存期在（5～6）年之间，S（t=5）=0.5193，S（t= 6）=0.4611，故将表格中数据代入公式得：/（5－T₅₀）=（0.5193－0.4611）/（0.5193－0.5），得出T₅₀=5.3（D对ABCE错）。